男，50岁。被发现昏倒在煤气热水器浴室内。查体：浅昏迷，血压160/90mmHg，口唇樱红色，四肢无瘫痪，尿糖（++），尿酮体（-），最可能的诊断是
A. 脑出血
B. 脑梗塞
C. 急性心肌梗死
D. 急性一氧化碳中毒
E. 糖尿病酮症酸中毒

正确答案：D。急性一氧化碳中毒

解析：中年男性患者，昏倒于煤气热水器浴室内（常见病因）。查体发现浅昏迷、口唇樱红色（一氧化碳中毒典型表现），患者最可能的诊断为急性一氧化碳中毒（D对）。脑出血（A错）多在情绪激动或活动中突然发病，发病后病情常于数分钟至数小时内达到高峰，血压明显升高，常有头痛、呕吐和不同程度的意识障碍，但无口唇樱红色。脑梗死（B错）多出现单侧肢体瘫痪或面部肌肉瘫痪及感觉障碍。急性心肌梗死（C错）主要表现为胸骨后濒死样疼痛，可出现室性心律失常，但无口唇粘膜呈樱红色改变。糖尿病酮症酸中毒（E错）临床表现为嗜睡、呼吸深快、呼气中有烂苹果味，血压下降，昏迷，尿糖强阳性、尿酮阳性。